男，45岁，急性胰腺炎，静脉应用广谱抗生素非手术治疗1周后，腹痛、腹胀加重，体温再度升高。若腹腔穿刺涂片查出大肠杆菌时，应选择的治疗措施是
A. 加用甲硝唑静脉点滴
B. 甲硝唑和广谱抗生素腹腔灌洗
C. 急诊行剖腹外引流手术
D. 急诊行剖腹内引流手术
E. 西药静脉点滴+中药胃管内滴注

正确答案：C。急诊行剖腹外引流手术

解析：该患者因胰腺炎入院，进行非手术治疗1周后，腹痛、腹胀加重，体温再度升高，提示该患者可能并发胰腺及周围坏死组织继发感染。急性胰腺炎时，由于大量呕吐、禁食治疗及肠血灌注减少，肠黏膜绒毛的营养状态急骤下降，肠黏膜屏障被破坏，使肠道内的大肠杆菌移位到胰腺及胰外侵犯的坏死组织内，从而发生胰腺及胰周坏死组织继发感染，出现腹痛、腹胀加剧及体温再度升高的症状。此时，应尽快行剖腹外引流手术（C对），将坏死组织清除并进行局部灌洗。内引流手术（D错）主要针对无菌性渗液的引流，比如胰腺假性囊肿。加用甲硝唑静脉点滴（A错）、甲硝唑和广谱抗生素腹腔灌洗（B错）、西药静脉点滴+中药胃管内滴注（E错）为非手术治疗措施，主要适用于尚无感染的急性胰腺炎，不能迅速消除坏死感染灶，可能造成病情进一步恶化。